关于IL-2的生物学效应，错误的是
A. 以自分泌和旁分泌方式发挥作用
B. 促进T细胞和B细胞的增殖分化
C. 增强NK细胞、单核细胞的杀伤活性
D. 抑制TH1细胞分泌IFN-γ
E. 诱导LAK细胞生成

正确答案：D。抑制TH1细胞分泌IFN-γ

解析：细胞因子是由免疫原、丝裂原或其他因子刺激细胞所产生的低分子量可溶性蛋白，具有多种调控机体免疫和非免疫系统发育与功能的作用。细胞因子的共同特点之一是通过自分泌、旁分泌、内分泌的方式作用于分泌细胞本身和邻近细胞（A对）。IL-1、IL-2、IL-4、IL-5、IL-6可促进T细胞和B细胞的增殖分化（B对）。IL-1、TNF-α、IFN-γ等可激活单核/巨噬细胞，增强其吞噬和杀伤功能；IL-2、IL-15、IL-1、IFN-γ等可诱导CTL和NK细胞杀伤活性（C对）。Th1细胞因子和Th2细胞因子是相互拮抗的，IL-4抑制Th1细胞的功能，IFN-γ抑制Th2细胞的功能（D错，为此题正确答案）。LAK细胞即淋巴因子激活的杀伤细胞，并非是一个独立的淋巴群或亚群，而是NK细胞或T细胞体外培养时，在高剂量IL-2等细胞因子诱导下成为能够杀伤NK不敏感肿瘤细胞的杀伤细胞（E对）。